直肠触诊触及质地坚硬、表面凸凹不平的包块，应考虑的是
A. 直肠息肉
B. 肛裂
C. 直肠癌
D. 直肠周围脓肿
E. 直肠炎

正确答案：C。直肠癌

解析：约80%的直肠癌直肠指检均可触及质地坚硬、凹凸不平的包块（C对）。直肠息肉（A错）肛指检查可触及单个或多个带蒂息肉或广基层肉，前者活动度大，后者较固定，息肉圆形、柔软。肛裂（B错）检查时可见溃疡面，新发生的肛裂边缘整齐、软，溃疡底浅，无瘢痕组织，色红，易出血。慢性肛裂深而硬，灰白色，不易出血。直肠周围脓肿（D错）初起无明显体征，以后出现红肿、压痛，直肠指检可扪及柔软有波动、有压痛的肿块，穿刺可抽出脓液。直肠炎（E错）触及不到包块。